雾化吸入。以上用药中，给药频次错误的是
A. 硝苯地平控释片
B. 氨溴索注射液
C. 异丙托溴铵溶液
D. 布地奈德混悬液
E. 莫西沙星氯化钠注射液

正确答案：E。莫西沙星氯化钠注射液

解析：本题考查用法用量。以上用药中，给药频次错误的是莫西沙星氯化钠注射液（E错，为本题正确答案）。莫西沙星氯化钠注射液推荐剂量为一次0.4g，一日1次。其他选项均正确。